患者，女，64岁。患高血压病多年，突然抽搐，头痛剧烈，呕吐，神昏，偏瘫，面红气粗，舌红苔黄，脉弦有力。治疗应首选
A. 龙胆泻肝汤
B. 羚角钩藤汤
C. 镇肝熄风汤
D. 三甲复脉汤
E. 天麻钩藤饮

正确答案：B。羚角钩藤汤

解析：热盛动风故见突然抽搐，神昏，偏瘫；肝阳暴亢，阳亢风动气血上逆引起头痛剧烈，呕吐，面红气粗；舌红苔黄，脉弦有力均是痰热内闭清窍证的表现，治疗应清热熄风，首选羚角钩藤汤（B对）。龙胆泻肝汤（A错）可以清泻肝胆实火，清利肝经湿热，用于治疗肝胆实火上扰证或肝经湿热下注证。镇肝熄风汤（C错）可以滋阴潜阳，镇肝熄风，用于治疗阴虚风动证。三甲复脉汤（D错）用于治疗温病邪热羁留下焦。天麻钩藤饮（E错）用于治疗肝阳暴亢，风阳上扰证。